纤维囊壁中含有大量淋巴样组织的囊肿是
A. 牙源性角化囊肿
B. 含牙囊肿
C. 鼻唇囊肿
D. 畸胎样囊肿
E. 鳃裂囊肿

正确答案：E。鳃裂囊肿

解析：鳃裂囊肿又称为颈部淋巴上皮囊肿，常位于颈上部近下颌角处，胸锁乳突肌上1/3前缘。一般认为鳃裂囊肿来自鳃裂或咽囊的上皮剩余，但也有人认为其发生可能与胚胎时期陷入颈淋巴结内的唾液腺上皮囊性变有关。囊肿好发于20～40岁的年轻患者，囊性肿物柔软，界限清楚，可活动，无明显症状，继发感染时可伴疼痛。囊肿一般发生于单侧。囊肿内含物为黄绿或棕色清亮液体，或含浓稠胶样、黏液样物。组织学上，90%以上的囊壁内衬复层扁平上皮，可伴或不伴角化，部分囊肿可内衬假复层柱状上皮，纤维囊壁内含有大量淋巴样组织并形成淋巴滤泡。第一鳃裂囊肿的囊肿壁内缺乏淋巴样组织，与表皮样囊肿相似。掌握“鳃裂囊肿”知识点。